发挥全身治疗作用的栓剂处方中往往需要加入吸收促进剂以增加药物的吸收，常用作栓剂吸收促进剂的是
A. 液状石蜡
B. 交联聚维酮（PVPP）
C. 四氟乙烷（HFA134a）
D. 乙基纤维素（EC）
E. 聚山梨酯80

正确答案：E。聚山梨酯80

解析：本题考查栓剂吸收促进剂。常用作栓剂吸收促进剂的是聚山梨酯80（E对）；液状石蜡（A错）可用作冷凝剂；交联聚维酮（PVPP）（B错）常用作片剂崩解剂；四氟乙烷（HFA134a）（C错）常用作抛射剂；乙基纤维素（EC）（D错）为片剂常用的黏合剂。